张某，12岁，因发热就诊，肌注青霉素后出现肢冷，汗出，血压下降，应采用下列哪种药物治疗
A. 去甲肾上腺素
B. 多巴胺
C. 肾上腺素
D. 氢化考的松
E. 间羟胺

正确答案：C。肾上腺素

解析：患者肌注青霉素后出现肢冷，汗出，血压下降等症状，应为肌注青霉素后的不良反应变态反应，导致过敏性休克的发生，应采用肾上腺素进行治疗（C对），肾上腺素主要用于过敏性休克、支气管哮喘及心搏骤停。去甲肾上腺素为抗休克的血管活性药，主要用于抢救急性低血压和周围血管扩张所引起的休克等（A错）。多巴胺适用于洋地黄及利尿无效的心功能不全，用于心脏手术、肾功能衰竭、充血性心力衰竭、心肌梗死、内毒素败血症、创伤等引起的休克综合征及补充血容量效果不佳的休克（B错）。氢化可的松为肾上腺皮质激素，用于肾上腺皮质功能减退症的替代治疗及先天性肾上腺皮质功能增生症的治疗，也可用于类风湿性关节炎、风湿性发热、痛风、支气管哮喘、过敏性疾病，并可用于严重感染和抗休克治疗等（D错）。间羟胺临床上可用于治疗休克早期及手术后或脊椎麻醉后的休克（E错）。